限制处方权后，仍连续2次以上出现超常处方且无正当理由的
A. 提出警告，限制处方权
B. 责令暂停执业
C. 吊销执业证书
D. 取消处方权
E. 现金处罚以示警告

正确答案：D。取消处方权

解析：医疗机构应当对出现超常处方3次以上且无正当理由的医师提出警告，限制其处方权；限制处方权后，仍连续2次以上出现超常处方且无正当理由的，取消其处方权。掌握“处方的开具、监督管理及法律责任”知识点。